某项队列研究得出的相对危险度为2.6，95%的可信区间为1.7～3.4.下列哪种说法不正确
A. 率差为1.7
B. 暴露与疾病的关联为正关联
C. 暴露组的发病危险比对照组高
D. 暴露组的发病危险是对照组的2.6倍
E. 该暴露因素是疾病的危险因素

正确答案：A。率差为1.7